既可利水渗湿，又可健脾安神的药物是
A. 茯苓
B. 猪苓
C. 泽泻
D. 薏苡仁
E. 白术

正确答案：A。茯苓

解析：茯苓药性甘、淡，平。归心、肺、脾、肾经。功效是利水渗湿，健脾，宁心（A对）。猪苓（B错）的功效是利水渗湿。泽泻（C错）的功效是利水渗湿，泄热，化浊降脂。薏苡仁（D错）的功效是利水渗湿，健脾止泻，除痹，排脓，解毒散结。白术（E错）的功效是健脾益气，燥湿利水，止汗，安胎。